位于鼻咽顶后壁粘膜下的是
A. 舌扁桃体
B. 咽扁桃体
C. 咽鼓管扁桃体
D. 腭扁桃体
E. 咽淋巴环

正确答案：B。咽扁桃体

解析：腭扁桃体(D错)位于扁桃体窝内，舌扁桃体(A错)位于舌根背面粘膜表面，咽扁桃体(B对)位于鼻咽部，咽鼓管扁桃体(C错)位于鼻咽部，咽淋巴环(E错)由鼻咽和口咽的结构和舌扁桃体构成。